男性，42岁。3天来右上后磨牙痛重，冷热加剧，夜间痛而来就诊。近1年多来，右上磨牙进食时咬到某特定位置时出现撕裂样痛，冷热敏感，平时咬物不适。检查：16咬合面似有近远中方向越过边缘嵴的细裂纹，颊尖高陡，无龋洞，不松动，叩痛（+）。为明确致病因素所作的检查不包括
A. 咬诊
B. 染色检查
C. 咬合关系检查
D. 温度试验
E. 电活力测验

正确答案：E。电活力测验

解析：本题考查隐裂。因为患牙检查结果“16咬合面似有近远中方向越过边缘嵴的细裂纹，颊尖高陡，无龋洞，不松动”表明牙髓的感染不是通过龋损和牙周疾病引起；加上病史提供的“近1年多来，右上磨牙进食时咬到某特定位置时出现撕裂样痛，冷热敏感，平时咬物不适”均提示患牙可能有牙硬组织疾病——牙隐裂，检查项目A～D项均可以查出牙隐裂的临床表现和诊断依据，唯有电活力测验（E错，为本题正确答案）对明确致病因素没有帮助。